伤寒肠穿孔多发生于
A. 病程的第1周，在小肠
B. 病程的第2周，在十二指肠
C. 病程的第3周，在回肠
D. 病程的第4周，在结肠
E. 恢复期，部位不定

正确答案：C。病程的第3周，在回肠

解析：伤寒肠穿孔是最严重的并发症，多见于病程第2～3周，多发生于回肠末段（C对）。